男，52岁。心悸头晕，四肢冰凉，见宽QRS波，心动过速，心律不规则。采取最合理的治疗是
A. 直流电复律
B. 静脉注射普罗帕酮
C. 静脉注射利多卡因
D. 静脉注射普鲁卡因酰胺
E. 静脉注射胺碘酮

正确答案：A。直流电复律

解析：患者中老年男性，见宽QRS波，心动过速，心律不规则，提示患者为室性心动过速，同时患者出现心悸头晕，四肢冰凉，表明患者出现室性心动过速同时伴有低血压、休克等血流灌注不足的症状，此时采取最合理的治疗是直流电复律（A对）。静脉注射利多卡因（C错）和普鲁卡因胺（D错）主要适用于无显著血流动力学障碍的室速患者，静脉注射普罗帕酮（B错）亦十分有效，但并不适用于已出现严重血流动力学障碍的患者。在无明显血流动力学障碍室速患者，其他药物治疗无效时，可选择静脉注射胺碘酮（E错）。